关于疾病年龄分布分析方法的叙述，正确的是
A. 横断面分析不能反映致病因子与年龄的关系
B. 出生队列是对不同年代出生的人群在同时期的发病率或死亡率进行分析
C. 致病因子在不同时期强度不同时，出生队列分析能反映疾病与年龄的关系
D. 出生队列研究实质是多组队列研究的综合应用
E. 对突发的新急性传染病也应该用出生队列研究，反映病原因素与年龄的关系

正确答案：C。致病因子在不同时期强度不同时，出生队列分析能反映疾病与年龄的关系